因出生后功能低下导致“呆小症”的是
A. 下丘脑
B. 腺垂体
C. 甲状腺
D. 肾上腺
E. 松果体

正确答案：C。甲状腺